下列关于乳恒牙区别的描述，正确的是
A. 乳牙体积小，牙冠呈淡黄色
B. 乳牙颈嵴不突出，冠根不分明
C. 下颌乳切牙舌面边缘嵴比下颌恒切牙明显
D. 乳磨牙的形态与相应的恒磨牙形态相似
E. 乳磨牙根干短，根分叉小

正确答案：C。下颌乳切牙舌面边缘嵴比下颌恒切牙明显

解析：本题考查乳恒牙的区别。下列关于乳恒牙区别的描述，正确的是下颌乳切牙舌面边缘嵴比下颌恒切牙明显（C对）。乳牙共20颗，上、下颌各10颗，位于中线两侧，左右成对排列。与恒牙比较，乳牙列中无乳前磨牙，自中线向远中依次为乳切牙乳尖牙和乳磨牙。除下颌第一乳磨牙的形态特殊外，其余乳牙的解剖形态与同名恒牙相似（D错）（上颌第一乳磨牙似前磨牙，上下颌第二乳磨牙似第一恒磨牙）。与恒牙比较，乳牙具有下列特点：1.乳牙呈乳白色，体积较同名恒牙小（A错），牙冠短而宽。2.乳牙颈部缩窄，颈嵴突出，牙根明显缩小，冠根分明（B错）。3.宽冠窄根是乳前牙的特点，但上颌乳中切牙为宽冠宽根。4.上颌乳尖牙的近中牙尖嵴长于远中牙尖嵴，是乳尖牙和恒尖牙中牙尖唯一偏远中者。5.乳磨牙体积依次递增，下颌第二乳磨牙近中颊尖、远中颊尖和远中尖等大。乳磨牙（牙合）方聚合度大，（牙合）面缩窄，尖、嵴、窝、沟不清晰。6.除上颌乳中切牙牙根扁宽外，其余乳前牙牙根细长，根尖均偏唇侧。乳磨牙根干特短，分叉度特大（E错），上颌乳磨牙为三根，即近、远中颊根和舌根，下颌乳磨牙为二根，即近中根和远中根。